瓜蒌薤白白酒汤可用以治疗的病证是
A. 胸痹
B. 心悸
C. 胁痛
D. 眩晕
E. 头痛

正确答案：A。胸痹

解析：本题考查瓜蒌薤白白酒汤的主治。其具有通阳散结，祛痰下气的功效。主治胸阳不振，痰气互结之胸痹（A对）。方中瓜蒌味甘性寒入肺，涤痰散结，开胸通痹；薤白辛温，通阳散结，化痰散寒，能散胸中凝滞之阴寒、化上焦结聚之痰浊、宣胸中阳气以宽胸，乃治疗胸痹之要药，共为君药。枳实下气破结，消痞除满；厚朴燥湿化痰，下气除满，二者同用，共助君药宽胸散结下气除满、通阳化痰之效，均为臣药。佐以桂枝通阳散寒，降逆平冲。诸药配伍，胸阳振，痰浊降，阴寒消，气机畅，则胸痹而气逆上冲诸症可除。